关于病例对照研究的下列论述，那项是正确的
A. 可直接研究疾病的发病率
B. 可直接计算相对危险度
C. 特别适用于罕见病的病因探索
D. 主要是失访偏倚
E. 可观察到一因多果

正确答案：C。特别适用于罕见病的病因探索

解析：本题考查病例对照研究的优缺点。病例对照研究特别适用于罕见病的病因探索（C对），但病例对照研究无法直接计算疾病的发病率（A错）和死亡率，因此不能直接计算相对危险度（B错），只能用比值比来近似估计相对危险度；病例对照研究不存在失访偏倚（D错）；病例对照研究是由果及因的研究，论证因果关系能力较弱（E错）。